肺炎喘嗽的基本病机是
A. 肺气失宣
B. 肺失清肃
C. 肺气上逆
D. 邪热闭肺
E. 痰热内蕴

正确答案：D。邪热闭肺

解析：肺气失宣，肺失清肃为小儿咳嗽的病机（AB错）。肺气上逆为邪气闭肺，肺失宣降，水液输化无权，凝为痰液，痰滞肺络，阻于气道，以致肺气上逆，不是基本病机（C错）。小儿外感风邪，外邪由口鼻或皮毛而入，侵犯肺卫，肺失宣降，清肃之令不行，致肺被邪束，闭郁不宣发为肺炎喘嗽（D对）。痰热内蕴为小儿咳嗽的病机（E错）。